生用走气分而泻火，炒黑入血分而止血的药是
A. 蒲黄
B. 栀子
C. 芦根
D. 知母
E. 小蓟

正确答案：B。栀子

解析：本题考查的是栀子的用法用量。生用走气分而泻火，炒黑入血分而止血的药是栀子（B对）。栀子：【用法用量】内服：煎汤，3～10g；或入丸散。外用：适量，研末调敷，或鲜品捣敷。生用走气分而泻火，炒黑入血分而止血，姜汁炒又除烦止呕。栀子仁（用种子）善清心除烦，栀子皮（用果皮）兼清表热。蒲黄（A错）：【用法用量】内服：煎汤，5～10g，布包；或入丸散。外用：适量，干掺，或调敷。止血宜炒炭用，活血宜生用。芦根（C错）：【用法用量】内服：煎汤，10～30g，鲜品可酌加。鲜用或捣汁饮，清热生津力佳。知母（D错）：【用法用量】内服：煎汤，6～12g；或入丸散。清泻实火宜生用，滋阴降火宜盐水炒用。小蓟（E错）：【用法用量】内服：煎汤，5～12g，鲜品30～60g；或入丸散，或捣汁。外用：适最，研末撒或调敷，或煎汤洗，或鲜品捣敷。炒炭兼收敛而止血力增强。